下列关于成熟不全型釉质形成缺陷症的表现，除外的是
A. 釉表面斑块状
B. 釉质较正常硬
C. 病变牙形态正常
D. 可出现斑块状的白、黄、棕色变色不透光区
E. X线检查釉质透光度与牙本质相似。

正确答案：B。釉质较正常硬

解析：成熟不全型釉质发育不全：成熟不全型的病变牙形态正常，但出现斑块状的白、黄、棕色变色不透光区，釉质较正常软，易磨耗。釉质易于从牙本质脱落，X线检查釉质透光度与牙本质相似。掌握“釉质形成缺陷（釉质发育不全）”知识点。